男，34岁。5日前施工时右下肢被石板砸伤，已清创缝合，患者突然出现右下肢胀裂感剧痛，伤口周围皮肤变黑，伤口裂开，肌肉呈熟肉样，其周围有捻发音，渗出物恶臭。可诊断为
A. 湿性坏疽
B. 干性坏疽
C. 气性坏疽
D. 骨筋膜室综合征
E. 破伤风

正确答案：C。气性坏疽

解析：男，34岁。5日前施工时右下肢被石板砸伤，已清创缝合（创造了无氧环境），患者突然出现右下肢胀裂感剧痛，伤口周围皮肤变黑，伤口裂开，肌肉呈熟肉样（提示由于局部张力，皮肤受压发白），其周围有捻发音，渗出物恶臭（有硫化氢），综上考虑为气性坏疽（C对）。湿性坏疽（A错）和干性坏疽（B错）皮下不会有捻发音。骨筋膜室综合征（D错）常由创伤骨折的血肿和组织水肿使其室内内容物体积增加或外包扎过紧，局部压迫使骨筋膜室容积减小而导致骨筋膜室内压力增高所致。创伤后肢体持续性剧烈疼痛，且进行性加剧，为本征最早期的症状，不会突然出现剧痛。破伤风（E错）典型症状是在肌紧张性收缩（肌强直、发硬）的基础上，阵发性强烈痉挛。